备洞过程中，引起的牙髓反应在临床上不可能表现为
A. 钻针切割牙体组织时疼痛
B. 切割牙体组织时只有酸痛感
C. 治疗结束后，仍有激发痛
D. 治疗结束后，出现自发痛
E. 治疗结束后，出现咬合痛

正确答案：E。治疗结束后，出现咬合痛

解析：本题考查充填后疼痛。治疗结束后，出现咬合痛，多因充填物过高，咬合时出现早接触所致，咬合痛为牙周性疼痛（E错，为本题的正确答案）。备洞过程中对牙髓产生机械刺激，可出现钻针切割牙体组织时疼痛（A对）、切割牙体组织时只有酸痛感（B对）。治疗结束后，仍有激发痛，可能的原因是备洞过程中如过冷的水冲洗窝洞、连续钻磨产热及钻磨产热等物理刺激激惹牙髓，致使牙髓充血（C对）。治疗结束后，出现自发痛，可能的原因为备洞时对牙髓状况判断失误，或有小的穿髓孔未被发现（D对）。